土壤生物性污染状况调查常用的监测指标为
A. 大肠菌值、产气荚膜杆菌值、活寄生虫卵数
B. 大肠菌值、破伤风杆菌、活寄生虫卵数
C. 大肠菌值、产气荚膜杆菌值、蛔虫卵数
D. 大肠菌值、破伤风杆菌、蛔虫卵数
E. 大肠菌值、产气荚膜杆菌值、破伤风杆菌

正确答案：C。大肠菌值、产气荚膜杆菌值、蛔虫卵数

解析：本题考查土壤生物性污染状况调查常用的监测指标。土壤生物性污染状况调查常用的监测指标有：1.大肠菌值：发现大肠菌的最少土壤克数称为大肠菌值。它是代表人畜粪便污染的主要指标，也是代表肠道传染病危险性的主要指标；2.产气荚膜杆菌值：也是代表粪便污染的指标。因为产气荚膜杆菌可以芽孢的形态在土壤中存活时间比大肠菌长。所以，研究它和大肠菌在土壤中数量的消长关系就可以判定土壤受粪便污染的时间长短；3.蛔虫卵数（C对ABDE错）：它对判定土壤污染有重要意义，因为它可以直接说明在流行病学上是否对人体健康有威胁。根据蛔虫卵在土壤中的不同发育阶段以及活卵所占的百分比来判断土壤的自净程度。